以下哪项不是定量研究的特点
A. 标准化程度较高
B. 可检验性强
C. 对研究问题的深层次探索性好
D. 精确化较高

正确答案：C。对研究问题的深层次探索性好

解析：本题考查定量研究的特点。定量研究的特点包括：1.研究的重点在于“验证假设”，一般有较为严密的逻辑架构；2.标准化（A对）和精确化程度较高（D对）；3.结果可以用具体指标表达，用概率统计的方法进行检验（B对）；4.具有较好的客观性和科学性，有较强的说服力。对研究问题的深层次探索性好（C错，为本题正确答案）不属于定量研究的特点。